发病前有明显的情绪紧张、恐惧、疼痛或站立过久等诱发因素，发作时眩晕昏仆，面色苍白，呼吸微弱，汗出肢冷，舌淡，脉沉细微。治宜选
A. 开窍顺气解郁
B. 开窍化痰解郁
C. 补气养血活血
D. 开窍活血顺气
E. 补气回阳醒神

正确答案：E。补气回阳醒神

解析：气厥由情志异常、精神刺激、素体虚弱等致气机上冲逆乱，清窍壅塞，神明失养而发。气虚不足，清阳不升，气陷于下，以致神明失养，不省人事，为厥之虚证，治宜补气，回阳，醒神（E对）。开窍顺气解郁为气厥实证的治法（A错）。